表观分布容积是指
A. 机体的总体积
B. 体内药量与血药浓度的比值
C. 个体体液总量
D. 个体血容量
E. 给药剂量与t时间血药浓度的比值

正确答案：B。体内药量与血药浓度的比值